《灵枢·天年》指出：“人之始生”
A. 以血为基，以气为楯
B. 以荣为基，以卫为楯
C. 以肉为基，以骨为楯
D. 以阴为基，以阳为楯
E. 以母为基，以父为楯

正确答案：E。以母为基，以父为楯

解析：人的生命来源于父母的精气，谓之“先天之气”，人之始生，以母为基，以父为楯（E对）。